男，60岁。排尿困难2个月。B超检查见前列腺增大，血清总PSA24ng/ml。为明确诊断，最可靠的检查方法是
A. 经直肠腔内超声
B. 前列腺MRI
C. 前列腺CT
D. 前列腺穿刺活检
E. 直肠指诊

正确答案：D。前列腺穿刺活检

解析：老年男性患者，排尿困难，B超示前列腺增大，血清总PSA24ng/ml（正常血清总PSA＜4.0ng/ml，提示有前列腺癌的可能），结合患者临床表现和相关检查，应考虑为前列腺癌。为明确诊断，最可靠的检查方法是前列腺穿刺活检（D对）。前列腺穿刺活检可以明确所获组织有无癌细胞，是前列腺癌诊断的金标准。经直肠腔内超声（A错）、前列腺MRI（B错）、前列腺CT（C错）等影像学检查可辅助前列腺癌的诊断，但可靠性均不及前列腺穿刺活检。直肠指检（E错）是前列腺癌常用的体检方法，可用于前列腺癌的初步筛查。